维生素B₁以辅酶形式主要参与
A. 蛋白质代谢
B. 脂肪代谢
C. 赖氨酸代谢
D. 糖代谢
E. 钙代谢

正确答案：D。糖代谢